临床上检查意识状态的方法一般多用
A. 问诊
B. 触诊
C. 叩诊
D. 听诊
E. 嗅诊

正确答案：A。问诊

解析：意识是大脑功能活动的综合表现，即对环境的知觉状态。判断患者的意识状态多采用问诊（A对BCDE错）的办法，是医师通过与患者或知情人交谈，详细了解疾病的历史与现状等临床资料，经过分析、综合、全面思考，提出初步临床判断的一种诊断方法，即通过交谈来了解患者的思维、反应、情感、计算及定向力等方面的情况。对较为严重者，甚至发生意识障碍（比如发生嗜睡、昏睡、意识模糊）的患者，尚应进行痛觉试验、瞳孔反射等检查，以确定患者意识障碍的程度。